女性，50岁，因呕吐、腹泻、低热于门诊应用庆大霉素32万U/日，共5天，近日来觉尿量有所减少约700～800ml/日，伴乏力、头晕，试验时检查尿蛋白（+），Hb100g/L，血清钾6.5mmol/L，BUN33.5mmol/L，血肌酐884mmol/L。最应采取的治疗手段是
A. 口服离子交换树脂
B. 大剂量呋塞米静脉注射
C. 按3-6g葡萄糖：1U胰岛素比例静滴补液
D. 限制入水量
E. 透析治疗

正确答案：E。透析治疗

解析：患者病程5天即出现血肌酐884 mmol/L，已进入尿毒症期，患者血钾6.5mmol/L（正常值3.5～5.5mmol/L）。因尿毒症毒素及高血钾会对机体各脏器造成损害以及导致心率失常，此时应首先予清除尿毒症毒素及降血钾，故最应采取的治疗手段是透析（E对），且还可清除体内过多的水分。口服离子交换树脂（A错）、大剂量呋塞米静脉注射（B错）、 按3～6g葡萄糖：1U胰岛素比例静滴补液（C错）均可以起到降低血钾的作用，但无法清除尿毒症毒素，且透析降血钾是最有效的降钾途径，故均非首选。限制入水量（D错）可减少体内的水潴留，降低容量负荷，但无法清除尿毒症毒素及降血钾，故非首选。